男，60岁。乏力、纳差、双下肢水肿3个月，腹胀、右季肋部隐痛2周。既往慢性乙型肝炎病史12年，未规律诊治。腹部B超：右肝部可见直径2.5cm低回声结节，腹腔内可见游离性暗区。为明确诊断，最有意义的实验室检查是
A. 糖链抗原199
B. 癌胚抗原
C. 胆红素
D. 丙氨酸氨基转移酶
E. 甲胎蛋白

正确答案：E。甲胎蛋白

解析：老年男性患者，既往慢性乙型肝炎病史，乏力、纳差、双下肢水肿，腹胀、右季肋部隐痛，右肝部可见直径2.5cm低回声结节，腹腔内可见游离性暗区。最可能的诊断是肝癌。为明确诊断，最有意义的实验室检查是甲胎蛋白（E对）。一项典型的肝癌影像学表现，病灶>2cm，AFP>400ng/ml，即可诊断肝癌。